咽鼓管的骨部，占咽鼓管全长
A. 内侧1/3
B. 内侧2/3
C. 外侧1/3
D. 外侧2/3
E. 内侧1/2

正确答案：C。外侧1/3

解析：咽鼓管骨部约占咽鼓管全长的外1/3（C对）。咽鼓管软骨部约占咽鼓管全长的内2/3（B错）。